常用作片剂润滑剂的辅料是
A. 滑石粉
B. 淀粉
C. 糊精
D. 糖粉
E. 微晶纤维素

正确答案：A。滑石粉

解析：本题考查的是片剂的润滑剂。常用作片剂润滑剂的辅料是滑石粉（A对）。片剂的常用润滑剂有（1）硬脂酸镁为白色细腻粉末。硬脂酸、硬脂酸锌和硬脂酸钙也可用作润滑剂，其中硬脂酸锌多用于粉末直接压片。（2）滑石粉为白色结晶性粉末，其成分为含水硅酸镁。多与硬脂酸镁等联合应用，以改善后者的疏水性。（3）聚乙二醇（PEG）常用PEG4000或PEG6000，为水溶性润滑剂，适用于可溶片或泡腾片。（4）月桂醇硫酸镁（钠）为水溶性表面活性剂，具良好润滑作用。（5）微粉硅胶为轻质白色无定形粉末，不溶于水，但亲水性强；比表面积大，有良好的流动性、可压性和附着性。稀释剂与吸收剂统称为填充剂。（1）淀粉（B错）白色细粉，性质稳定，能与大多数药物配伍。必要时可与适量黏合力较强的糊精、糖粉合用，以改善其可压性。（2）糊精（C错）系淀粉水解的中间产物，为白色（白糊精）或微黄色（黄糊精）细粉。（3）糖粉（D错）为蔗糖粉碎而成的白色细粉，味甜，易溶于水，易吸潮结块。润湿剂与黏合剂微晶纤维素（E错）为纤维素部分水解而成的聚合度较小的白色针状微晶。